患儿，男，10岁，患麻疹后3天，低热乏力，颌下淋巴结肿大，牙龈疼痛、出血、口腔奇臭，不敢刷牙，检查可见下前牙唇侧牙龈出血，龈缘溃疡。最佳治疗方案应选择
A. 全口洁治，口服或肌注青霉素
B. 局部用1%～2%过氧化氢溶液含漱，口服维生素和甲硝唑
C. 2%～4%NaHCO3溶液含漱，补充铁剂、维生素A，并输血
D. 口服激素+阿司匹林镇痛
E. 该病有自限性，无需特殊处理，7～10天可自愈

正确答案：B。局部用1%～2%过氧化氢溶液含漱，口服维生素和甲硝唑

解析：本题考查急性坏死性龈炎的最佳治疗方案。患儿男，10岁，患麻疹（急性传染病）后3天，低热乏力（重度全身症状），颌下淋巴结肿大，牙龈疼痛、出血、口腔奇臭（组织坏死），不敢刷牙，检查可见下前牙唇侧牙龈出血，龈缘溃疡。上述症状，拟诊为急性坏死性龈炎，该病的最佳治疗方案为局部用1%～2%过氧化氢溶液含漱，口服维生素和甲硝唑（B对）。全口洁治，口服或肌注青霉素（A错）适用于掌跖角化-牙周破坏综合征，基于此病是伴放线聚集杆菌或其他致病微生物的感染。2%～4%NaHCO3溶液含漱，补充铁剂、维生素A，并输血（C错）适用于受到真菌感染并且贫血的情况。口服激素+阿司匹林镇痛（D错）可用于天疱疮类的疾病，并搭配中医中药等其他措施进行治疗。该病有自限性，无需特殊处理，7～10天可自愈（E错）不符合急性坏死性龈炎的特点。